躯干、四肢本体觉传导通路第2级神经元是
A. 薄束核和楔束核
B. 胶状质
C. 三叉神经脊束核
D. 孤束核
E. 无

正确答案：A。薄束核和楔束核

解析：躯干、四肢本体觉传导通路第1级神经元是脊神经节内假单极神经元，第 2 级神经元是薄束核和楔束核（A对），第 3 级神经元的胞体在丘脑腹后外侧核。